根治间日疟最好选用
A. 伯氯喹+乙胺嘧啶
B. 氯喹+乙胺嘧啶
C. 伯氨喹+奎宁
D. 伯氨喹+氯喹
E. 青蒿素+乙胺嘧啶

正确答案：D。伯氨喹+氯喹

解析：本题考查伯氨喹和氯喹的临床应用。根治间日疟最好选用伯氨喹+氯喹（D对）。氯喹的抗疟作用主要为干扰疟原虫红内期裂殖体DNA的复制和转录过程或阻碍了内吞作用，从而使虫体因缺乏氨基酸而死亡，伯氨喹对红外期与配子体有较强的杀灭作用，主要用于根治间日疟和控制复发和疾病传播，常与氯喹合用根治间日疟和控制疟疾传播。